治疗肾阳虚之不孕症，应首选
A. 温胞饮
B. 养精种玉汤
C. 开郁种玉汤
D. 启宫丸
E. 开郁二陈汤

正确答案：A。温胞饮

解析：肾阳虚之不孕证治宜温肾补气养血，调补冲任，方选温胞饮（A对）。不孕症之肾阴虚证方选养精种玉汤（B错）。不孕症之肝气郁结证方选开郁种玉汤（C错）。启宫丸祛痰燥湿，开郁化气，活血，助生气；治妇人体肥痰盛，子宫脂满，不能孕育者（D错）。开郁二陈汤的功效是开郁行滞，在临床上经常治疗女性非正常闭经，特别是青年女性因为生气、情绪抑郁、焦虑、打击等各种因素，导致月经不调，出现闭经的情况（E错）。